属于颞下颌关节紊乱病不可逆性保守治疗的是
A. 药物治疗
B. 物理治疗
C. 封闭治疗
D. 咬合导板治疗
E. 正畸治疗

正确答案：E。正畸治疗

解析：本题考查颞下颌关节紊乱病不可逆性的保守治疗。颞下颌关节紊乱病的治疗方法很多，归纳起来其防治原则为：1.以保守治疗为主，采用对症治疗和消除或减弱致病因素相结合的综合治疗。2.改进全身状况和患者的精神状态。3.对患者进行医疗知识教育。4.遵循一个合理的、合乎逻辑的治疗程序。5.治疗程序应先用可逆性保守治疗，再用不可逆性保守治疗，最后选用关节镜外科和各种手术治疗。不可逆性保守治疗包括调（牙合）、正畸治疗（E对）等，能不可逆的改变咬合关系。可逆性保守治疗创伤小，包括药物治疗（A错）、物理治疗（B错）、封闭治疗（C错）和咬合导板治疗（D错）等。